关于腺泡的叙述中正确的是
A. 腺泡连接于导管末端的盲囊
B. 由单层腺上皮细胞组成
C. 外侧为薄的基底膜包绕
D. 可分为浆液性、黏液性、混合性三种
E. 以上都正确

正确答案：E。以上都正确

解析：腺泡为连接于导管末端的盲囊，由单层腺上皮细胞组成，为腺的分泌部，其外侧为薄的基底膜包绕。在腺细胞和基膜之间含有肌上皮细胞，它具有收缩能力，有助于腺细胞分泌物的排出。根据腺泡的形态、结构和分泌物性质的不同，可分为浆液性、黏液性、混合性三种类型。掌握“唾液腺组织结构”知识点。